患儿自汗，头、肩、背出汗明显，活动后加重，易感冒，神倦乏力，面色少华，四肢欠温，舌淡苔薄，脉弱。其治法是
A. 调和营卫
B. 益气固表
C. 益气养阴
D. 益气敛汗
E. 敛汗潜阳

正确答案：B。益气固表

解析：患儿自汗，头、肩、背出汗明显，活动后加重，当属汗证。其肺卫不固，外邪易侵，卫阳之气无力温煦，故易感冒；神倦乏力，面色少华，四肢欠温，舌淡苔薄，脉弱亦为肺卫不固之象，治宜益气固表（B对）。调和营卫用于汗证之营卫失调证，证候特点为汗出遍身而抚之不温（A错）。益气养阴用于汗证之气阴亏虚证，症见以盗汗为主，也常伴自汗，形体消瘦，汗出较多，神萎不振，心烦少寐，寐后汗多，或伴低热、口干、手足心灼热，哭声无力，口唇淡红，舌质淡，苔少或见剥苔，脉细弱或细数（C错）。益气敛汗可用于汗证偏气虚者，症候特点见哭声无力，少气懒言，神萎不振（D错）。敛汗潜阳可用于汗证偏阳虚者，症候特点可见汗出不止，四肢不温（E错）